急性失血性贫血
A. 大细胞性贫血
B. 正细胞性贫血
C. 单纯小细胞性贫血
D. 小细胞低色素性贫血
E. 造血不良性贫血

正确答案：B。正细胞性贫血

解析：本题考查急性失血性贫血的相关内容。急性失血性贫血一般属于正细胞性贫血（B对ACDE错）。根据出血率的不同，血红蛋白下降的速度也不同，可见于呼吸道出血、消化道出血、泌尿系统出血等。可分为轻度、中度和重度，出血性贫血患者较为容易诊断，部分血红蛋白低的患者或许会出现相应的贫血临床症状，如心悸、头晕、气短等症状。